由自身抗体诱导的Ⅱ型超敏反应引起的疾病是
A. 支气管哮喘
B. 荨麻疹
C. 溶血性贫血
D. 接触性皮炎
E. 血清病

正确答案：C。溶血性贫血

解析：Ⅱ型超敏反应包括溶血性贫血（C对）；支气管哮喘（A错）和荨麻疹（B错）属于Ⅰ型超敏反应的常见疾病。血清病（E错）属于Ⅲ型超敏反应的常见疾病。接触性皮炎（D错）属于Ⅳ型超敏反应常见疾病。